连翘败毒散治疗紫癜
A. 风热伤络证
B. 血热妄行证
C. 气不摄血证
D. 阴虚火旺证
E. 气滞血瘀证

正确答案：A。风热伤络证

解析：连翘败毒散具有疏风散邪，清热凉血的作用，可用于紫癜之风热伤络证，该证由风热之邪外感，内窜血络所致（A对）。血热妄行证应选用犀角地黄汤清热解毒，凉血止血（B错）。气不摄血证可选用归脾汤健脾养心，益气摄血（C错）。阴虚火旺证可选用大补阴丸滋阴降火，凉血止血（E错）。